高血压病肝阳亢盛化风证的治法是
A. 清肝泻火
B. 平肝潜阳
C. 镇肝熄风
D. 养肝滋肾
E. 疏肝理气

正确答案：C。镇肝熄风

解析：治疗肝阳上亢化风急需熄风，故治法为镇肝熄风（C对），方药用镇肝熄风汤加减。清肝泻火（A错）治疗肝火亢盛证。平肝潜阳（B错）治疗肝阳上亢证。养肝滋肾（D错）治疗肝肾阴虚证。疏肝理气（E错）治疗肝郁气滞证。